慢性肾功能不全之阴阳两虚证治宜
A. 附子理中丸合五苓散
B. 济生肾气丸合真武汤
C. 杞菊地黄丸
D. 全鹿丸
E. 六味地黄丸

正确答案：D。全鹿丸

解析：慢性肾功能不全之阴阳两虚证，机理病久损耗机体元阳真阴，阳气虚衰，推动无力，则周身乏力，阳虚失于温煦，则畏寒肢冷；阴虚内热则手足心热，阴虚失养而口干欲饮、腰膝酸软，故治宜温扶元阳，补益真阴，治疗宜用温补肾阳，兼补真阴的全鹿丸加减（D对）。附子理中丸合五苓散（A错）可温阳祛寒，健脾祛湿，多用于治疗脾阳虚湿盛证；济生肾气丸合真武汤（B错）可温补脾肾，多用于治疗脾肾阳虚证；杞菊地黄丸（C错）可滋肾平肝，多用于治疗肝肾阴虚证；六味地黄丸（E错）滋阴补肾，多用于治疗肾阴亏虚证。